每块椎骨均有
A. 横突
B. 横突孔
C. 肋凹
D. 上、下关节突
E. 末端分叉的棘突

正确答案：A。横突

解析：每块椎骨均有横突（A对）。只有颈椎横突有孔（B错）。只有胸椎有肋凹（C错）。第 1 颈椎又名寰椎，无椎体、棘突和关节突（D错）。第 7 颈椎又名隆椎, 棘突长，末端不分叉（E错）。